游离香豆素的提取分离方法有
A. 水蒸气蒸馏法
B. 碱溶酸沉淀法
C. 系统溶剂法
D. 色谱法
E. 分馏法

正确答案：A、B、C。水蒸气蒸馏法；碱溶酸沉淀法；系统溶剂法

解析：本题考查的是香豆素的提取分离方法。游离香豆素的提取分离方法有水蒸气蒸馏法（A对）、碱溶酸沉淀法（B对）、系统溶剂法（C对）。游离香豆素类成分多为结晶性物质，有比较敏锐的熔点，但也有很多香豆素类成分呈玻璃态或液态。分子量小的游离香豆素类化合物多具有芳香气味与挥发性，能随水蒸气蒸馏出来，且具升华性。碱溶酸沉法用溶剂法提取香豆素类成分，常有大量中性杂质存在，可利用香豆素类具有内酯结构，能溶于稀碱液而和其他中性成分分离，碱溶液酸化后内酯环合，香豆素类成分即可游离析出，或用乙醚等有机溶剂萃取得到。溶剂提取法香豆素类成分可用多种溶剂提取，如甲醇、乙醇、丙酮、乙醚等。提取方法可采用乙醚等溶剂先提取脂溶性成分，再用甲醇（乙醇）或水提取极性大的成分。也可先用甲醇（乙醇）或水提取，再用溶剂法或大孔吸附树脂法区分脂溶性部位和水溶性部位。溶剂提取法是香豆素类成分提取的主要方法。